食物中毒的潜伏期最常以
A. 算术均数
B. 中位数
C. 几何均数
D. 标准差
E. 百分位数

正确答案：B。中位数

解析：中位数：是一组由小到大按顺序排列的观察值中位次居中的数值，用M表示。可用于描述任何分布，特别是偏态分布资料以及频数分布的一端或两端无确切数据资料的中心位置。例如，某些传染病或食物中毒的潜伏期、人体的某些特殊测定指标（如发汞、尿铅等），其集中趋势多用中位数来表示。掌握“定量资料的统计描述和推断”知识点。